18岁女性，无明显不适，月经周期正常，最近体检所见子宫正常大小，子宫左侧可及一大小7cm×6cm×5cm硬度不均肿块，表面光滑，可活动，可能的诊断为
A. 浆膜下子宫肌瘤
B. 卵巢畸胎瘤
C. 输卵管积水
D. 子宫内膜异位囊肿
E. 卵巢炎性囊肿

正确答案：A。浆膜下子宫肌瘤